关于第一和第二心音的判定，错误的是
A. S₁音调较S₂低
B. S₁至S₂的距离较S₂至下一心搏S₁的距离短
C. 桡动脉的向外搏动与S₁同步或几乎同步
D. S₂在心底较响
E. S₁时限较S₂长

正确答案：C。桡动脉的向外搏动与S₁同步或几乎同步

解析：通常情况下，第一心音与第二心音的判断并无困难：S₁音调较S₂低（A对），时限长（E对）。S₁在心尖区最响而S₂在心底较响（D对）。S₁至S₂的距离较S₂至下一心搏S₁的距离短（B对）。心尖或颈动脉的向外搏动与S₁同步或几乎同步，而非桡动脉（C错，为本题正确答案）。